DNA的Toll样受体是
A. TLR2
B. TLR4
C. TLR5
D. TLR7
E. TLR9

正确答案：B。TLR4